糖皮质激素可
A. 减少胃酸及胃蛋白酶的分泌
B. 降低中枢神经系统的兴奋性
C. 导致骨质疏松
D. 导致血管收缩
E. 抑制骨髓造血功能

正确答案：C。导致骨质疏松